营养价值较高的食物，其多种营养素的INQ值应大于
A. 1
B. 1/2
C. 1/3
D. 3/4
E. 1/10

正确答案：A。1